患者男性，68岁，因牙列缺损行可摘局部义齿，主诉义齿单侧咬合或前牙咬合时，另一侧或后牙区义齿就会翘动，或者嘴巴一动上颌或下颌的牙齿就会脱落，影响进食，为哪种现象
A. 疼痛
B. 固位不良
C. 义齿摘戴困难
D. 咀嚼不良
E. 食物嵌塞

正确答案：B。固位不良

解析：固位不良：患者通常主诉义齿单侧咬合或前牙咬合时，另一侧或后牙区义齿就会翘动，或者嘴巴一动上颌或下颌的牙齿就会脱落，影响进食。掌握“局部义齿修复后出现的问题及处理”知识点。